黄芩的主产地是
A. 西藏
B. 河南
C. 云南
D. 河北
E. 浙江

正确答案：D。河北

解析：本题考查的是黄芩的主产地。黄芩的主产地是河北（D对）。黄芩：【产地】主产于河北、山西、内蒙古、辽宁等省区。道地药材（又称地道药材）是指药材质优效佳。藏药：主产地青藏高原地区（A错）。著名的藏药如冬虫夏草、雪莲花、炉贝母、红景天，以及甘松、胡黄连、藏木香、藏菖蒲、余甘子、毛诃子、麝香等。怀药：主产地河南（B错）。如著名的“四大怀药”——地黄、牛膝、山药、菊花；以及天花粉、瓜蒌、白芷、辛夷、红花、金银花、山茱萸等。云药：主产地云南（C错）。如三七、木香、重楼、茯苓、萝芙木、诃子、草果、马钱子、儿茶等。浙药：主产地浙江（E错）。如传统的“浙八味”——浙贝母、白术、延胡索、温郁金、玄参、杭白芍、杭菊花、杭麦冬；以及山茱萸、莪术、杭白芷、栀子、乌梅、乌梢蛇等。